关于嗜酸性腺瘤的镜下表现说法正确的一项是
A. 光镜观察，嗜酸性腺瘤细胞主要为大嗜碱性粒细胞
B. 明细胞胞质呈鲜明的嗜伊红染色，胞核浓缩，小而深染
C. 暗细胞胞核居中，椭圆形，空泡状，有一个或多个核仁，偶见双核
D. 近包膜处常见不等量淋巴细胞，但不形成滤泡
E. 肿瘤细胞磷钨酸苏木精（PTAH）染色阴性

正确答案：D。近包膜处常见不等量淋巴细胞，但不形成滤泡

解析：光镜观察，嗜酸性腺瘤细胞主要为大嗜酸性粒细胞，其中胞核居中，椭圆形，空泡状，有一个或多个核仁，偶见双核，称为“明细胞”。还有胞质呈鲜明的嗜伊红染色，胞核浓缩，小而深染，称为“暗细胞”。肿瘤细胞磷钨酸苏木精（PTAH）染色阳性。近包膜处常见不等量淋巴细胞，但不形成滤泡。掌握“沃辛瘤及嗜酸性腺瘤”知识点。